竞争性拮抗剂的特点是
A. 亲和力及内在活性都强
B. 具有一定亲和力但内在活性弱
C. 与亲和力和内在活性无关
D. 有亲和力、无内在活性，与受体不可逆性结合
E. 有亲和力、无内在活性，与激动剂竞争相同受体

正确答案：E。有亲和力、无内在活性，与激动剂竞争相同受体

解析：本题考查作用于受体药物的分类。竞争性拮抗剂的特点是有亲和力、无内在活性，与激动剂竞争相同受体（E对）。竞争性拮抗剂具有较强的亲和力，能与受体结合，但缺乏内在活性（α=0）。可与激动剂竞争相同的受体，且其拮抗作用可逆，与激动剂合用时的效应取决于两者的浓度和亲和力。亲和力及内在活性都强（A错）的是激动药。具有一定亲和力但内在活性弱（B错）的是部分激动剂。与亲和力和内在活性无关（C错）的是非特异性药物。有亲和力、无内在活性，与受体不可逆性结合（D错）的是非竞争性拮抗剂。